有辛凉平剂之称的是
A. 参苏饮
B. 柴葛解肌汤
C. 银翘散
D. 桑菊饮
E. 麻杏石甘汤

正确答案：C。银翘散

解析：银翘散用银花配伍荆芥、豆豉、牛蒡子、竹叶，解表清热之力强，为“辛凉平剂”。（C对）。参苏饮（A错）为治疗气虚外感风寒，内有痰湿证之常用方。柴葛解肌汤（B错）的配伍特点为温清相伍，三阳并举，表里同治，重在疏泄透散。桑菊饮为辛凉轻剂（D错）。麻杏石甘汤（E错）为辛凉重剂。